病毒性心肌炎的确诊有赖于
A. 血肠道病毒核酸阳性
B. 血清柯萨奇B组病毒IgG滴度1：640以上
C. 心肌组织内病毒的检出
D. 血C反应蛋白水平增高
E. 血清柯萨奇B组病毒IgM滴度1：320以上

正确答案：C。心肌组织内病毒的检出

解析：病毒性心肌炎的诊断主要为临床诊断。根据典型的前驱感染史、相应的临床表现及体征、心电图、心肌酶学检查或超声心动图、CMR显示的心肌损伤证据，应考虑此诊断。确诊有赖于EMB（心内膜心肌活检）检出病毒（C对BE错）。血肠道病毒核酸阳性（A错）提示近期肠道有病毒感染，与病毒性心肌炎无关。血C反应蛋白水平增高（D错）提示机体受到感染或者损伤，只能了解病情，不能确诊疾病。